患者女性，31岁，左下后牙、左下颌角区反复肿胀3个月，开口困难。检查开口度一指半，阻生牙牙龈充血糜烂，挤压有少量脓液溢出，嚼肌区膨隆明显，质硬，轻度压痛。应选择下列何种措施
A. 观察
B. 局部理疗
C. 大剂量抗生素的使用
D. 切开引流
E. 病灶刮治术

正确答案：E。病灶刮治术

解析：本题考查边缘性骨髓炎的治疗。边缘性骨髓炎，常因智齿冠周炎引发咬肌间隙感染，如不及时切开引流排脓（D错），反复肿胀化脓常导致骨膜炎或骨膜下脓肿的骨密质外板的炎性病变，即边缘性颌骨骨髓炎，应行死骨摘除及病灶刮治术（E对），术后应合理配合使用抗菌药物（C错）。边缘性骨髓炎仅观察而不采取措施，则炎症反复急性发作，病情向颌骨内扩展，波及骨髓腔，形成广泛性骨坏死（A错）。理疗是康复治疗的主要内容（B错）。